完全随机的样本分析中，样本总数30，分为3组，每组的组内自由度是多少
A. 27
B. 3
C. 29
D. 2
E. 26

正确答案：A。27

解析：在完全随机的样本分析中，样本总数30，分为3组，每组的组内自由度是n-k＝30-3＝27”（A对BCDE错）。